石细胞中含有草酸钙方晶的中药材是
A. 马钱子
B. 苦杏仁
C. 补骨脂
D. 豆蔻
E. 栀子

正确答案：C。补骨脂